介水传染病的流行特点不包括
A. 多为暴发流行
B. 病例分布与供水范围一致
C. 发病多在同一潜伏期内
D. 对水源采取净化消毒处理后，流行迅速得到控制
E. 病人的病情复杂，临床表现多种多样

正确答案：E。病人的病情复杂，临床表现多种多样

解析：本题考查介水传染病的流行特点。介水传染病指通过饮用或接触受病原体污染的水而传播的疾病。其流行特点为：①水源一次严重污染后，可呈暴发流行（A对），短期内突然出现大量病人，且多数患者发病日期集中在同一潜伏期内（B对）。若水源经常受污染，则发病者可终年不断，病例呈散发流行；②病例分布与供水范围一致（C对）。大多数患者都有饮用或接触同一水源的历史；③一旦对污染源采取治理措施，并加强饮用水的净化和消毒后，疾病的流行能迅速得到控制（D对）。病人的病情复杂，临床表现多种多样（E错，为本题正确答案）不是介水传染病的流行特点。